不属于大隐静脉属支的是
A. 小隐静脉
B. 股内、外侧浅静脉
C. 阴部外静脉
D. 腹壁浅静脉
E. 旋髂浅静脉

正确答案：A。小隐静脉

解析：小隐静脉（A错，为本题正确答案）收集足外侧部和小腿后部浅层结构的静脉血，不属于大隐静脉属支。股内、外侧浅静脉（B对）、阴部外静脉（C对）、腹壁浅静脉（D对）、旋髂浅静脉（E对）为大隐静脉的5条属支。